辛伐他汀引起的药源性疾病
A. 急性肾衰竭
B. 横纹肌溶解
C. 中毒性表皮坏死
D. 心律失常
E. 听力障碍

正确答案：B。横纹肌溶解

解析：本题考查药源性疾病。他汀类引起的药源性疾病是横纹肌溶解（B对）；急性肾衰竭（A错）可能由环孢素引起；中毒性表皮坏死（C错）可能由磺胺类、非甾体抗炎药等引起；心律失常（D错）可能由地高辛引起；听力障碍（E错）可能由氨基糖苷类、非甾体抗炎药等引起。